善调经止痛的药是
A. 香附
B. 青皮
C. 川楝子
D. 荔枝核
E. 化橘红

正确答案：A。香附

解析：本题考查的是香附的功效。善调经止痛的药是香附（A对）。香附：【功效】疏肝理气，调经止痛。青皮（B错）：【功效】疏肝破气，消积化滞。川楝子（C错）：【功效】行气止痛，杀虫，疗癣。荔枝核（D错）：【功效】行气散结，祛寒止痛。化橘红（E错）：【功效】理气宽中，燥湿化痰，消食。